女，临床表现单侧乳腺肿块，疑乳腺癌，发生骨转移和肺转移，需要做乳腺肿块活检，行内分泌治疗，哪项用以确定靶向治疗方案
A. P25
B. HER2
C. ER
D. Ki-67
E. PR

正确答案：B。HER2

解析：靶向治疗通过转基因技术制备的曲妥珠单抗对HER2 过度表达的乳腺癌病人有良好效果，可降低乳腺癌病人术后的复发转移风险，提高无病生存期，结合患者表现和活检，行内分泌治疗，用HER2确定靶向治疗方案。